脑膜中动脉通过
A. 棘孔
B. 圆孔
C. 卵圆孔
D. 茎乳孔
E. 无

正确答案：A。棘孔

解析：脑膜中动脉通过棘孔（A对）。圆孔（B错）有上颌神经通过；卵圆孔（C错）有下颌神经通过；茎乳孔（D错）有面神经通过。